环甲膜切开手术在作为紧急抢救措施时，插管不易超过
A. 6h
B. 12h
C. 18h
D. 24h
E. 48h

正确答案：E。48h

解析：如呼吸已停止，可紧急行环甲膜切开术进行抢救，随后改行常规气管切开术。环甲膜切开术只能作为紧急抢救患者的临时措施，不能长期代替气管切开。应在48h内行常规气管切开术后，缝合环甲膜切开伤口。掌握“口腔颌面部创伤急救”知识点。